视交叉的交叉纤维
A. 由两眼颞侧视网膜节细胞发出的神经纤维组成
B. 由两眼鼻侧视网膜节细胞发出的神经纤维组成
C. 由右眼颞侧和左眼鼻侧视网膜发出的神经纤维组成
D. 与两眼鼻侧视野有关
E. 由左眼颞侧和右眼鼻侧视网膜发出的神经纤维组成

正确答案：B。由两眼鼻侧视网膜节细胞发出的神经纤维组成

解析：视交叉参与视觉传导通路，该通路由三级神经元组成。第一级神经元为视网膜内的双极细胞。第二级神经元为视网膜内的节细胞（B对），由节细胞发出的轴突形成视神经，经视神经管进入颅腔。在视交叉处，来自两眼视网膜颞侧半的纤维左右交叉，两眼鼻侧半交叉后的纤维和颞侧半不交叉的纤维形成左、右视束。